根据《互联网药品信息服务管理办法》，《互联网药品信息服务资格证书》的发证部是
A. 信息产业主管部门
B. 工商行政管理部门
C. 卫生行政部门
D. 药品监督管理部门
E. 电信管理机构

正确答案：D。药品监督管理部门

解析：本题考查服务网站开办资格证书的申请与审批程序。根据《互联网药品信息服务管理办法》，《互联网药品信息服务资格证书》的发证部是药品监督管理部门（D对）。服务网站开办资格证书的申请与审批程序：申请提供互联网药品信息服务，应当填写国家药品监督管理部门统一制发的《互联网药品信息服务申请表》，向网站主办单位所在地省级药品监督管理部门提出申请并提交相应材料。省（区、市）药品监督管理部门在收到申请材料之日起5日内做出受理与否的决定，自受理之日起20日内对申请提供互联网药品信息服务的材料进行审核，并作出同意或者不同意的决定；符合条件的，由省（区、市）药品监督管理部门核发《互联网药品信息服务资格证书》，同时报国家药品监督管理局备案并发布公告。《互联网药品信息服务资格证书》的格式由国家药品监督管理部门统一制定。